48岁，糖尿病史7年，外阴痒2月余，白带无异味，妇检：阴道粘膜充血，白带多，呈凝乳块状。本例最可能的诊断是
A. 细菌性阴道病
B. 老年性阴道炎
C. 外阴硬化性苔癣
D. 非特异性外阴炎
E. 念珠菌阴道炎

正确答案：E。念珠菌阴道炎

解析：该患者，有糖尿病病史（患有糖尿病时，机体免疫力下降，阴道组织内糖原增加，酸度增高，有利于假丝酵母菌生长），阴道粘膜充血，白带多，呈凝乳块状（妇科检查可见阴道黏膜红肿，分泌物白色稠厚呈凝乳或豆腐渣样），故本例最可能的诊断是念珠菌阴道炎（E对），又称外阴阴道假丝酵母菌病。细菌性阴道病（P251）（A错）表现为阴道分泌物增多，有鱼腥臭味。老年性阴道炎（P252）（B错）表现为阴道分泌物稀薄，呈淡黄色，感染严重者呈脓血性白带。外阴硬化性苔藓（P243）（C错）表现为外阴病损区瘙痒以及外阴灼烧感。非特异性外阴炎（P246）（D错）表现为外阴皮肤黏膜瘙痒、疼痛、灼烧感，于活动、性交、排尿及排便时加重，检查见外阴充血、肿胀、糜烂，常有抓痕，严重者形成溃疡或湿疹。